某男，20岁。素体较弱，近1月来时发肢麻，甚则抽搐。曾在某医院就诊治疗无效。刻诊肢麻依旧，纳食及二便正常。舌淡红，苔薄腻，脉弦。证属血虚经脉失养兼有风湿。治以养血舒筋、祛风除湿。药用当归12g炒、白芍15g、酒木瓜10g、鸡血藤15g、炙甘草6g、秦艽10g防风、防己各10g、桑枝30g、生牡蛎30g打碎先煎。6剂每日1剂水煎服。宜避风寒忌食生冷、着凉水。以此方加减治疗半年身体复常。方中秦艽苦辛微寒，其功效不包括
A. 祛风湿
B. 清虚热
C. 化瘀止痛
D. 舒筋络
E. 利湿退黄

正确答案：C。化瘀止痛

解析：本题考查的是秦艽的功效。方中秦艽苦辛微寒，其功效不包括化瘀止痛（C错，为本题正确答案）。秦艽：【功效】祛风湿（A对），舒筋络（D对），清虚热（B对），利湿退黄（E对）。化瘀止痛为瓦楞子的功效。瓦楞子：【功效】消痰化瘀，软坚散结，制酸止痛。